下面哪一项不属于控制菌斑的药物的特点
A. 能杀灭特异性致病菌
B. 不受口腔和菌斑中其他成分的影响
C. 不易引起细菌的耐药性
D. 对口腔和全身无毒副作用
E. 能长时间停留在口腔中发挥作用

正确答案：E。能长时间停留在口腔中发挥作用

解析：本题考查控制菌斑的药物的特点。能长时间停留在口腔中发挥作用（E错，为本题的正确答案）不属于控制菌斑的药物的特点。在机械性控制菌斑的基础上，配合药物可有效地控制菌斑，达到预防和治疗牙周病的目的。控制菌斑的药物应具有以下特点：能杀灭菌斑微生物或抑制其生长繁殖，能杀灭特异性致病菌（A对）；性质稳定，不受口腔和菌斑中其他成分的影响（B对）；快速杀灭微生物，不易引起细菌的耐药性（C对）；对口腔和全身无毒副作用（D对）或副作用少，不引起机体的变态反应。季铵化合物在口腔内很快被清除，不能保持疗效，洗必泰主要用于局部含漱、擦涂和冲洗，不能长时间停留在口腔中发挥作用。